《中华人民共和国药品管理法》规定批准并发给《医疗机构制剂许可证》的部门是
A. 国务院药品监督管理部门
B. 国务院卫生行政部门
C. 国务院劳动和社会保障部门
D. 省、自治区、直辖市人民政府药品监督管理部门
E. 省、自治区、直辖市人民政府卫生行政部门

正确答案：D。省、自治区、直辖市人民政府药品监督管理部门

解析：本题考查药品使用管理。《中华人民共和国药品管理法》规定医疗机构配制制剂，须经所在地省、自治区、直辖市人民政府卫生行政部门审核同意，由省、自治区、直辖市人民政府药品监督管理部门（D对）批准，发给《医疗机构制剂许可证》。